某药品生产企业在核对药品包装时，发现印有批号的标签剩余，标签领用人应
A. 核对使用数及剩余数是否与领用数相符
B. 将印有批号的剩余标签退回专库存放并作好记录
C. 将印有批号的剩余标签交岗位操作人销毁并作好记录
D. 将印有批号的剩余标签交标签保管员销毁并作好记录
E. 将印有批号的剩余标签交专人负责计数销毁并作好记录

正确答案：A、E。核对使用数及剩余数是否与领用数相符；将印有批号的剩余标签交专人负责计数销毁并作好记录